疾病的发生归结到一点，这就是人体
A. 感受了外邪
B. 阴阳失调
C. 先天禀赋不足
D. 正气虚衰
E. 生理功能衰减

正确答案：B。阴阳失调

解析：感邪即发，指机体感受病邪后，随即发病。常见于外感六淫、部分病气、中毒、外伤及虫兽伤、情志过激等所致的疾病。根据邪正交争原理，感邪后正气抗邪反应强烈，可迅速导致人体阴阳失调，并表现出明显的临床症状和体征，最终还是阴阳失调（A错）。机体脏腑经络的生理活动正常，气血阴阳协调平衡，形与神俱，以及机体与外环境的协调统一，是维持健康状人态的基础（B对）。先天禀赋不足，对某些疾病具有易感性（C错）。正气充盛，奋起抗邪，邪正相搏剧烈，多表现为实证；正气不足，脏腑功能减退，精气血津液亏损，多表现为虚证或虚实夹杂证。若正气虚衰，不能敌邪，邪气易千深入内脏，为病多重。因此，正气的盛衰不仅决定着发病与否，还与病证的深浅和性质有关（D错）。机体的精气血津液不足或脏腑经络等生理功能减弱，抗病能力低下，是以正气虚损为矛盾主要方面的病机变化（E错）。